单侧三叉神经损害可出现的表现是
A. 单侧眼睑下垂
B. 单侧额纹消失
C. 单侧鼻唇沟浅
D. 单侧舌肌萎缩
E. 单侧角膜反射消失

正确答案：E。单侧角膜反射消失

解析：单侧三叉神经损害可出现的表现是单侧角膜反射消失（E对）。三叉神经损害表现：检查一侧角膜反射发现双侧角膜反射消失，见于受试侧三叉神经麻痹，此时健侧受试则双侧角膜反射存在；下颌反射亢进，见于双侧皮质脑干束病变。